血尿最常见的原因
A. 运动后血尿
B. 药物所致的血尿
C. 前列腺炎
D. 泌尿系感染
E. 泌尿系结石

正确答案：E。泌尿系结石